与细菌运动有关的是
A. 荚膜
B. 芽胞
C. 鞭毛
D. 菌毛
E. 异染颗粒

正确答案：C。鞭毛

解析：鞭毛在某些细菌菌体上具有细长而弯曲的丝状物，称为鞭毛。鞭毛的长度常超过菌体若干倍。在某些菌体上附有细长并呈波状弯曲的丝状物，少则1～2根，多则可达数百根。这些丝状物称为鞭毛，是细菌的运动器官。掌握“细菌的特殊结构及检查方法”知识点。